患者，男，55岁。患胃癌。胃脘胀满疼痛，痛引两胁，情志不舒，善怒，喜太息，嗳腐吞酸，呃逆呕吐，吞咽不畅，脉弦。其证型是
A. 肝胃不和
B. 脾胃虚寒
C. 胃热伤阴
D. 气血双亏
E. 脾虚痰湿

正确答案：A。肝胃不和

解析：胃脘胀满疼痛，痛引两胁，情志不舒，善怒，喜太息，脉弦，为肝郁的表现；嗳腐吞酸，呃逆呕吐，吞咽不畅为胃气上逆的表现；故诊断为肝胃不和证（A对）。脾胃虚寒证（B错）的特点为胃脘隐痛，绵绵不断，喜按喜暖，食生冷痛剧，进热食则舒，时呕清水，大便溏薄，或朝食暮吐，暮食朝吐，面色无华，神疲肢凉。胃热伤阴证（C错）的特点为胃脘嘈杂灼热，痞满吞酸，食后胀痛，口干喜冷饮，五心烦热，便结尿赤，舌质红绛，舌苔黄糙或剥苔。气血双亏证（D错）的特点为神疲乏力，面色无华，少气懒言，动则气促、自汗，消瘦，舌苔薄白，舌质淡白。脾虚痰湿证（E错）的特点为脘膈痞闷，呕吐痰涎，进食发噎不利，口淡纳呆，大便时溏时结，舌体胖大有齿痕。